下列关于大气二次污染物的说法不正确的是
A. 光化学烟雾是二次污染物
B. 一次污染物经化学或光化学作用生成
C. 与一次污染物的化学性质不同的，新的污染物
D. 二次污染物的毒性往往更大
E. 刮风时再次进入大气的铅尘是二次污染物

正确答案：E。刮风时再次进入大气的铅尘是二次污染物

解析：本题考查二次污染物的相关内容。二次污染物是指排入大气的污染物在物理、化学等因素的作用下发生变化，或与环境中的其他物质发生反应所形成（B对）的理化性质不同于一次污染物（C对）的新的污染物。常见的有光化学烟雾（A对）。一般来说，二次污染物对环境和人体的危害要比一次污染物大（D对）。刮风时再次进入大气的铅尘（E错，为本题正确答案）不是二次污染物。